65岁女性，全口多数牙缺失，仅余留左上78，且松动Ⅲ°，牙龈红肿，牙槽嵴高度适中，颌间距离正常。修复前应做的工作是
A. 做牙槽骨修整术
B. 拔除左上78
C. 做前庭沟加深术
D. 左上78牙周治疗
E. 以上都需要

正确答案：B。拔除左上78

解析：本题考查修复前的准备及处理。该患者仅余留的左上78松动Ⅲ°，对于牙槽骨吸收达到根2/3以上，牙松动达Ⅲ度者予以拔除，因此修复前应拔除左上78（B对）。拔牙时由于创伤过大造成牙槽嵴变形甚至骨折而又未能及时复位者，或拔牙后骨质吸收不均者，常形成骨尖或骨突。若一段时间后仍不消退，且有疼痛，或有明显倒凹妨碍义齿摘戴时，应进行牙槽骨修整术（A错）去除过突的骨尖或骨突。牙槽嵴过度吸收致使义齿的固位差时，可施行前庭沟加深术（C错）。